细胞受刺激兴奋时，膜内电位负值减小称为
A. 极化
B. 去极化
C. 复极化
D. 超极化
E. 反极化

正确答案：B。去极化